哪项不是条件致病菌产生的因素
A. 寄生部位改变
B. 全身免疫功能低下
C. 局部免疫功能低下
D. 菌群失调
E. 药物治疗

正确答案：E。药物治疗

解析：机会致病菌的致病条件：①菌群失调：机体某部位正常菌群中各菌种间的比例发生大的改变。②寄生异位：如某些大肠埃希菌是肠道内的常见菌，当它们进入泌尿道，就会引起泌尿道感染；进入腹腔，可引起化脓性腹膜炎等。③机体免疫力低下：包括使用大剂量皮质激素、抗肿瘤药物和放射治疗时，以及重症患者如AIDS患者和晚期肿瘤患者。掌握“细菌的分类”知识点。